关于急性风湿热的实验室检查的特点的描述错误的是
A. 血沉增快
B. C反应蛋白增高
C. 血白细胞增多
D. 心电图P-R间期缩短
E. 抗链球菌抗体滴度升高

正确答案：D。心电图P-R间期缩短

解析：风湿热是一种咽喉部A组乙型溶血性链球菌感染后反复发作的全身结缔组织炎症，因此实验室检查可出现提示链球菌感染的指标如白细胞升高（C对）、抗链球菌抗体滴度升高（E对）。风湿热急性期80%的患者出现红细胞沉降率（ESR）增快（A对）和C反应蛋白（CRP）升高（B对）。风湿性心脏炎累及心脏传导组织，引起房室传导减慢，其心电图表现为P-R间期延长（D错，为本题正确答案）。